医学心理学是哪一门科学的分支学科
A. 医学
B. 社会学
C. 心理学
D. 生理学
E. 生理心理学

正确答案：C。心理学